在进行医德评价时，应防止的“四种片面依据论”不是指
A. 唯意志论
B. 唯动机论
C. 唯效果论
D. 唯目的论
E. 唯手段论

正确答案：A。唯意志论